苏合香芳香辛散，温通开窍，其成人的一日内服量是
A. 0.01～0.015g
B. 0.03～0.06g
C. 0.09～0.2g
D. 0.3～1g
E. 1.5～2g

正确答案：D。0.3～1g

解析：本题考查的是苏合香的用法用量。合香芳香辛散，温通开窍，其成人的一日内服量是0.3～1g（D对）。苏合香：【用法用量】内服：入丸散，0.3～1g，不入煎剂。瓜蒂：【使用注意】本品作用强烈，易损伤正气，故孕妇、体虚、失血及上部无实邪者忌服。若呕吐不止，用麝香0.01～0.015g（A错），开水冲服可解。斑蝥：【用法用量】外用：适量，研末，或浸酒、醋，或制油膏涂敷患处。内服：炮制后入丸散，0.03g～0.06g（B错）。用量为0.09g～0.2g（C错）或1.5g～2g（E错）的中药，2022年考试指南未明确说明。